引起梅毒的病原体是
A. 艰难梭菌
B. 苍白密螺旋体
C. 甲型溶血性链球菌
D. 白假丝酵母菌（白念珠菌）
E. 变异链球菌

正确答案：B。苍白密螺旋体

解析：引起梅毒的病原体是苍白密螺旋体（B对）。艰难梭菌引起抗生素相关性腹泻和假膜性结肠炎（A错）。甲型溶血性链球菌是引起亚急性感染性心内膜炎最常见的致病菌（C错）。白假丝酵母菌引起假丝酵母菌病（D错）。变异链球菌与常见病龋齿关系密切（E错）。